脑脊液主要产生于
A. 软脑膜
B. 蛛网膜
C. 脉络丛
D. 蛛网膜颗粒
E. 室管膜上皮

正确答案：C。脉络丛

解析：脑脊液主要产生于脑室脉络丛（C对），少量可由室管膜上皮（E错）和毛细血管产生。